属物理灭菌法的有
A. 热压灭菌法
B. 紫外线灭菌法
C. 环氧乙烷灭菌法
D. 流通蒸汽灭菌法
E. 干热灭菌法

正确答案：A、B、D、E。热压灭菌法；紫外线灭菌法；流通蒸汽灭菌法；干热灭菌法

解析：本题考查的是物理灭菌法。属物理灭菌法的有热压灭菌法（A对）、紫外线灭菌法（B对）、流通蒸汽灭菌法（D对）、干热灭菌法（E对）。物理灭菌法包括干热灭菌法、湿热灭菌法、射线灭菌法、滤过灭菌法。干热灭菌法包括：焚烧、烧灼、干烤、红外线。湿热灭菌法包括：巴氏消毒法、煮沸法、流动蒸气消毒法、间歇蒸气灭菌法、高压蒸气灭菌法。射线灭菌法包括：紫外线、电离辐射、微波。滤过灭菌法。